有机磷中毒的解救药物是
A. 阿托品+碘解磷定
B. 氟马西尼
C. 硫代硫酸钠
D. 乙酰半胱氨酸
E. 纳洛酮

正确答案：A。阿托品+碘解磷定

解析：本题考查中毒解救。有机磷中毒的解救药物是阿托品+碘解磷定（A对）。有机磷中毒的解救选用阿托品+碘解磷定或氯解磷定。氟马西尼（B错）用于苯二氮䓬类药物中毒解救。硫代硫酸钠（C错）用于抢救氰化物中毒，治疗可溶性钡盐（如硝酸钡）、砷、汞、铋、铅等金属中毒。乙酰半胱氨酸（D错）用于对乙酰氨基酚过量所致的中毒。纳洛酮（E错）用于阿片类药物中毒的解救。